研究某种疾病导致的死亡对居民生命的影响时，下列那种方法最
A. 简略寿命表
B. 现时寿命表
C. 定群寿命表
D. 去死因寿命表

正确答案：D。去死因寿命表

解析：本题考查去死因寿命表。去死因寿命表（D对ABC错）是用来分析某种疾病或某类疾病对平均预期寿命等指标的影响，可以综合说明某类死因对人群生命的影响程度。